在体内可发生脱甲基代谢，其代谢产物仍保持抗抑郁活性的药物有
A. 氟西汀
B. 盐酸阿米替林
C. 盐酸帕罗西汀
D. 文法拉辛
E. 舍曲林

正确答案：A、B、D、E。氟西汀；盐酸阿米替林；文法拉辛；舍曲林

解析：本题考查抗抑郁药。在体内可发生脱甲基代谢，其代谢产物仍保持抗抑郁活性的药物有氟西汀（A对）、盐酸阿米替林（B对）、文拉法辛（D对）、舍曲林（E对）。大部分药物体内脱甲基代谢物有活性，如阿米替林、氟西汀、文拉法辛代谢物与原药活性等同，只有帕罗西汀（C错）代谢物无活性。舍曲林能选择性抑制5-HT的重摄取，强化了5-HT受体的神经传递。本品口服吸收缓慢而持久，体内广泛而大量的药品经过肝脏的首过效应形成活性较弱的去甲基舍曲林。